与成釉细胞每天的周期性形成有关，并可代表每天釉质形成速度的是
A. 芮氏线
B. 新生线
C. 横纹的形成
D. 埃布纳生长线
E. 欧文线

正确答案：C。横纹的形成

解析：横纹是釉柱上与釉柱的长轴垂直的细线，透光性低。横纹的形成与成釉细胞每天的周期性形成有关，代表每天釉质形成的速度。掌握“牙釉质”知识点。